一次静脉给药5mg，药物在体内达到平衡后，测定其血浆药物浓度为0.35mg/L，表观分布容积约为
A. 5L
B. 28L
C. 14L
D. 1.4L
E. 100L

正确答案：C。14L

解析：本题考查表观分布容积。表观分布容积公式V=X/C式中，X为体内药物量，V是表观分布容积，C是血药浓度，代入X=5mg，C=0.35mg/L，可求得V=X/C=5mg/0.35（mg/L）=14L（C对）。